血燥生风的病因是
A. 生血不足或失血过多
B. 久病耗血或年老精亏
C. 产后恶露日久不净
D. 热病后期，阴津亏损
E. 水不涵木，浮阳不潜

正确答案：B。久病耗血或年老精亏

解析：血燥生风，指血虚津亏，失润化燥，肌肤失于濡养而生风的病机变化。多由久病伤阴耗血，或年老精亏血少，或长期营养缺乏，生血不足，或淤血内结，新血生化障碍等原因，导致局部或全身肌肤失于濡养，经脉气血失于和调，血燥而化风（B对）。血虚生风，多由于生血不足或失血过多所致（A错）。产后恶露日久不净，失血过多易导致血虚生风（C错）。阴虚风动多见于热病后期，津液阴气大量亏损或由于久病耗伤，津液阴气亏虚所致（D错）。水不涵木，浮阳不潜，肝阳上亢，为肝阳化风（E错）。